下列哪一种牙龈病最常见
A. 急性坏死溃疡性龈炎
B. 急性龈乳头炎
C. 慢性龈缘炎
D. 妊娠期龈炎
E. 牙龈瘤

正确答案：C。慢性龈缘炎

解析：本题考查最常见的牙龈病。慢性龈缘炎（C对）是牙龈病中最常见的疾病，其患病率高，涉及的人群广，世界各地区、各民族、各年龄段的人都可以发生，几乎每个人在其一生中的某个时间段都可发生不同程度和不同范围的慢性龈炎。而其他选项都是发生在特定的人群中或特定的部位：急性坏死溃疡性龈炎（A错）常发生于青壮年，以男性吸烟者多见。目前，在经济发达的国家中，此病已很鲜见，在我国也已逐渐减少；急性龈乳头炎（B错）病损只局限于个别牙龈乳头，主要由机械或化学刺激引起，不如慢性牙龈炎常见；妊娠期龈炎（D错）只发生在妊娠期的妇女，由于女性激素水平升高，原有的牙龈慢性炎症加重，使牙龈肿胀或形成龈瘤样的改变；牙龈瘤（E错）主要发生在中青年女性。